属于骨关节炎导致的畸形变是
A. 纽扣花样畸形
B. 方形手
C. 手关节尺侧偏斜
D. 天鹅颈样畸形
E. 杵状指

正确答案：B。方形手

解析：骨关节炎最常累及远端指间关节，也可见于近端指间关节和第一腕掌关节，累及第一腕掌关节易导致方形手畸形（B对）。纽扣花样畸形（A错）、手关节尺侧偏斜（C错）和天鹅颈样畸形（D错）为类风湿性关节炎的常见畸形表现（P808）。杵状指（E错）常见于慢性缺氧性疾病（如支气管扩张、慢性肺脓肿等），某些心血管疾病（如发绀型先天性心脏病，亚急性感染性心内膜炎等）和营养障碍性疾病，骨关节炎不会出现。